房水最后回流至
A. 玻璃体
B. 睫状体
C. 脉络膜
D. 巩膜静脉窦
E. 海绵窦

正确答案：D。巩膜静脉窦

解析：房水最后回流至巩膜静脉窦（D对）。